对个体污染物摄入量变异研究更加有效的膳食摄入量评估方法是
A. 询问法
B. 称量法
C. 24小时回顾法
D. 双份饭研究
E. 食物频率法

正确答案：D。双份饭研究

解析：本题考查膳食摄入量评估方法。一般来说，膳
食摄入量评估有三种方法：总膳食研究、单个食品的选择性研究和双份饭研究。其中双份饭研究（D对ABCE错）对个体污染物摄入量的变异研究更加有效。